美国药典即
A. FDA
B. WHO
C. USP
D. 0TC
E. UPS

正确答案：C。USP

解析：本题考查药典。美国药典即USP（C对）。《美国药典》 (USP) 由美国药典委员会编辑出版，现与《美国国家处方集》 (NF) 合并出版，缩写为 USP-NF；FDA（A错）是美国食品与药品管理局的缩写；WHO（B错）是世界卫生组织的缩写；OTC（D错）是非处方药的缩写；UPS（E错）为《美国药典》USP的错误拼写。